具有软似绵，肿似馒，皮色不变，不紧不宽等病变特点的疾病是
A. 脂瘤
B. 血瘤
C. 筋瘤
D. 肉瘤
E. 骨瘤

正确答案：D。肉瘤

解析：生于体表的肿瘤分为6 种，即：气瘤、血瘤、筋瘤、肉瘤、骨瘤、脂瘤。相当于西医的部分体表良性肿瘤。肉瘤多见于成年女性，可发于身体各部，好发于肩、背、腹、臀及前臂皮下。大小不一，边界清楚，皮色不变，生长缓慢，触之柔软，呈扁平团块状或分叶状，推之可移动，基底较广阔，一般无疼痛（D对）。多发者常见于四肢、胸或腹部，呈多个较小的圆形或卵圆形结节，质地较一般肉瘤略硬，压之有轻度疼痛。